新生儿先天性胸腺缺陷将导致
A. 严重细胞免疫和体液免疫缺陷
B. 细胞免疫正常
C. 体液免疫正常
D. 影响体液免疫
E. 只影响细胞免疫

正确答案：A。严重细胞免疫和体液免疫缺陷

解析：本题考查新生儿先天性胸腺缺陷。细胞免疫应答即为T细胞介导的免疫应答；体液免疫应答即为分为对T细胞依赖抗原（TD-Ag）的免疫应答和对T细胞非依赖抗原（TI-Ag）的免疫应答；在应答过程中，前者需要Th细胞的辅助，后者不需要。胸腺是T细胞分化、成熟的场所，若胸腺发育不全或缺失，则导致T细胞缺乏和细胞免疫功能缺陷，且胸腺基质细胞所产生的多种细胞因子和胸腺肽类分子，不仅能调控胸腺细胞的分化、发育，而且对外周免疫器官和免疫细胞也有调节作用，故新生儿先天性胸腺缺陷将导致严重细胞免疫和体液免疫缺陷（A对BCDE错）。